下列除哪项外，均可出现口臭
A. 龋齿
B. 心火旺盛
C. 胃热
D. 宿食
E. 内痈

正确答案：B。心火旺盛

解析：心火亢盛证患者的证候表现为心烦失眠，或烦躁胡言乱语，意识不清；或舌上生疮，溃烂疼痛；或吐血，衄血；或小便短赤，且尿道灼热涩痛。伴随发热口渴，便秘尿黄，面红舌赤，苔黄脉数等（B错，为本题正确答案）。牙疳即为龋齿（A对），表现为口气奇臭难闻，牙眼腐烂。胃热（C对）上蒸于口，则口气难闻，臭秽。食积胃肠（D对），兼见食少纳呆，脘腹胀满者，可闻及口气酸臭。患溃腐疮痈者（E对），大多病室有腐臭气。